口服用于肠道感染或肠道手术前准备的药物是
A. 妥布霉素
B. 链霉素
C. 庆大霉素
D. 阿米卡星
E. 大观霉素

正确答案：C。庆大霉素

解析：本题考查庆大霉素。庆大霉素（C对）为氨基糖苷类抗菌药，用于敏感革兰阴性杆菌所致的严重感染，包括肠道感染。妥布霉素（A错）用于治疗绿脓杆菌引起的各种感染。链霉素（B错）临床上主要与其它抗结核药联合用于结核分枝杆菌所致各种结核病的初治病例。阿米卡星（D错）用于对庆大霉素及妥布霉素耐药的革兰阴性杆菌感染和大多数需氧革兰阴性杆菌感染，并对结核分枝杆菌有效。大观霉素（E错）用于淋病奈瑟菌所致的尿道炎、前列腺炎、宫颈阴道炎和直肠感染，以及对青霉素、四环素等耐药菌株引起的感染。